某职工从沿海某城市回到农村，腹泻1天，10余次，水样便，到市医院求治，疑为肠炎，后大便培养出EI-Tor型细菌（霍乱）。国家要求上报此类传染病不超过
A. 2小时
B. 3小时
C. 5小时
D. 1小时
E. 24小时

正确答案：A。2小时

解析：患者大便培养出EI-Tor型细菌，应诊断为霍乱，属于甲类传染病，国家规定上报此类传染病时间不超过2小时（A对）。